在面部轴型皮瓣的长宽比例为
A. 2：1
B. 3：1
C. 4：1
D. 5：1
E. 在血管长轴内不受长宽比例的限制

正确答案：E。在血管长轴内不受长宽比例的限制

解析：本题考查皮瓣移植-轴型皮瓣。面部轴型皮瓣是由一对知名血管供血与回流，因而设计皮瓣时在血管长轴内不受长宽比例的限制（E对）。皮瓣移植分为带蒂皮瓣和游离皮瓣，其中带蒂皮瓣包括随意皮瓣和轴型皮瓣。随意皮瓣也称皮肤皮瓣，由于没有知名的血管供血，故在设计皮瓣时，其长宽比例要受到一定限制。在肢体与躯干部位，长宽之比1.5：1为最安全，最好不超过2：1（A错）；在面部，由于血液循环丰富，根据实际情况可放宽到2～3：1（B错），在血供特别丰富的部位可达4：1（C错）。5：1（D错）比例太大，不能保证移植皮瓣的成活。